一般认为根管充填的时机是
A. 髓腔已完全清理、扩大和成形
B. 无自发疼、叩诊无反应
C. 窦道口封闭、根尖区牙龈无红肿，无压痛
D. 无腐败臭味、根管内无脓和血
E. 以上全对

正确答案：E。以上全对

解析：本题考查根管充填的时机。当达到下列条件时可以进行根管充填：①.已经过严格的根管预备和消毒，根管制备成良好的形态且根管内的感染物质已被彻底清理（A对）是根管充填的基本条件；②.患牙无疼痛或其他不适（B对），患牙有明显叩痛或其他不适，通常提示炎症或感染的存在；③在初诊时通过根管预备和消毒处理，大多数窦道会愈合（C对），此时可以完成根管充填。根管无异物，无明显渗出物（D对），如果根管内存在渗出物，则提示根尖周组织处于急性炎症期或有根尖周囊肿。根管内异物或恶臭提示根管或根尖周处于较严重的感染状态；④暂封材料完整；⑤根管充填必须在严格隔湿条件下进行。（ABCD均对，故E为本题的正确答案）。